肿势平坦，根盘散漫，常见于正虚不能托毒之疮疡的是
A. 气肿
B. 瘀血肿
C. 郁结
D. 虚肿
E. 湿肿

正确答案：D。虚肿

解析：虚肿指肿势平坦，根盘散漫，常见于正虚不能托毒之疮疡（D对）。气肿指皮紧内软，按之凹陷，复手即起，似皮下藏气，富有弹性，不红不热，或随喜怒消长。常见于气瘘、乳癖等（A错）。瘀血肿指肿而胀急，病程较快，色初暗褐，后转青紫，逐渐变黄至消退。也有血肿染毒、化脓而肿。常见于皮下血肿等（B错）。郁结指肿势坚硬，表面不平或有棱角，状如岩突，不红不热（C错）。湿肿指皮肉重垂胀急，深按凹陷，如烂棉不起，浅则光亮如水疱，破流黄水，浸淫皮肤。常见于股肿、湿疮（E错）。